关于豆状核的描述，正确的是
A. 位于内囊内侧
B. 被两个白质板分成3部分
C. 与背侧丘脑之间相连
D. 外侧部为苍白球，内侧部为壳
E. 位于岛叶的浅部

正确答案：B。被两个白质板分成3部分

解析：豆状核为纹状体的组成部分，位于岛叶深部（E错），内囊外侧（A错），借内囊与内侧的尾状核、背侧丘脑分开（C错）。豆状核在水平切面上呈三角形，被两个白质板分成3部分（B对），外侧部最大称壳，内侧两部分合称苍白球（D错）。